治疗齿痛项强首选的是
A. 鱼际
B. 太渊
C. 列缺
D. 尺泽
E. 少商

正确答案：C。列缺

解析：该题主要考察腧穴主治。列缺主治为①咳嗽、气喘、咽喉肿痛等肺系病证；②偏正头痛、齿痛（C对）、项强痛、口眼歪斜等头面部病证；③手腕痛。太渊主治为咳嗽、肺系病证；无脉症；腕臂痛（B错）。鱼际主治咳嗽、咯血、咽干、咽喉肿痛、失音等肺系实热病证；掌中热；小儿疳积（A错）。少商主治为咽喉肿痛、鼻衄、高热等肺系实热病证；昏迷、癫狂等急症（E错）。尺泽主治为咳嗽、气喘、咯血、咽喉肿痛等肺系实热病证；肘臂挛痛；急性吐泻、中暑、小儿惊风等急症（D错）。